食物特殊动力最高的
A. 无机盐
B. 蛋白质
C. 糖类
D. 维生素
E. 氨基酸

正确答案：B。蛋白质

解析：食物的特殊动力效应是指进食能刺激机体额外消耗能量的作用，蛋白质的食物特殊动力最高（B对），其次为混合食物，最后是糖（C错）和脂肪，ADE不属于食物的特殊动力效应的内容（ADE错）。